实验研究是
A. 将研究对象按随机原则分为实验组和对照组
B. 实验组与对照组不是随机的
C. 实验组（干预组）和对照组在某些方面必须相似
D. 常用于行为观察
E. 从原因到结果的调查研究

正确答案：A。将研究对象按随机原则分为实验组和对照组